菌斑内细菌间的相互关系
A. 共生
B. 拮抗
C. 竞争
D. 共生、拮抗、竞争共存
E. 因人而异

正确答案：D。共生、拮抗、竞争共存

解析：本题考查菌斑内细菌间的相互关系。口腔微生物之间关系错综复杂，其中大多数为正常菌群，也有一些为某些情况下短暂发现的过路菌。寄居在口腔表面或牙周特殊部位的各种微生物，具有三种主要的相互关系：一是呈现相互有力的共生，如提供营养物质或能量来源；二是表现为负性关系的竞争如竞争营养物质和空间位置；另一种是某些微生物抑制或杀死另种微生物的拮抗。所以菌斑内细菌间的相互关系为共生、拮抗、竞争共存（D对ABC错）。由于菌斑的成分在不同人之间相似，所以菌斑内细菌间的相互关系在人与人之间大体相同，都存在共生、拮抗、竞争共存这四种关系，不存在因人而异（E错）的现象。